对乙酰氨基酚
A. 抗炎作用很弱
B. 对癌症疼痛无效
C. 一般剂量即可延长出血时间
D. 不可用于关节强直性脊椎炎
E. 增加血小板血栓素（TXA2）合成

正确答案：A。抗炎作用很弱

解析：本题考查对乙酰氨基酚的药理作用与临床应用。对乙酰氨基酚抗炎作用很弱（A对），因其在外周组织对抑制前列腺素合成没有明显作用。根据癌痛的三阶梯疗法，第一阶梯，轻度疼痛时，可选用非阿片类镇痛药，如阿司匹林；也可选用胃肠道反应较轻的布洛芬和对乙酰氨基酚（B错）。一般剂量即可延长出血时间（C错）可见于乙酰水杨酸，可不可逆的抑制血小板环氧合酶，减少血小板中血栓素A2的生成，影响血小板的聚集及抗血栓形成。关节强直性脊椎炎的药物治疗，对非甾体抗炎药有禁忌症和（或）不能耐受的患者，可以考虑应用诸如乙酰氨基酚和阿片类药物等镇痛药（D错）。对乙酰氨基酚无抗凝作用，不能增加血小板血栓素（TXA2）合成（E错）。